下列各项，不属溻渍法适应证的是
A. 阳证疮疡初起
B. 阴证疮疡
C. 美容
D. 保健
E. 创面干燥，僵而不敛

正确答案：E。创面干燥，僵而不敛

解析：溻是将饱含药液的纱布或棉絮湿敷患处，渍是将患处浸泡在药液中。溻渍法是通过湿敷、淋洗、浸泡患处的物理作用，以及不同药物对患部的药效作用而达到治疗目的的一种方法。近年来，溻渍法除了治疗疾病外，在用途上有了新的发展，如药浴美容、保健防病，其适应证有阳证疮疡初起、溃后；半阴半阳证及阴证疮疡；美容，保健等。而创面干燥，僵而不敛可用针灸法治疗（ABCD错）（E对）。